用于评价制剂吸收的主要指标是
A. K
B. Cl
C. t1/2
D. Vd
E. F

正确答案：E。F

解析：本题考查评价制剂吸收的主要指标。F（E对）为吸收系数（0≦F≦1），表示吸收占剂量的分数值，也称为“生物利用度”；k（A错）为速率常数；Cl（B错）为清除率；t1/2（C错）为生物半衰期；Vd（D错）是药物的特征参数，其值能够表示出该药物的分布特性。